服药后应多喝开水防止尿内结晶形成的药物是
A. 呋喃唑酮
B. 甲氧苄啶
C. 氧氟沙星
D. 磺胺嘧啶
E. 甲硝唑

正确答案：D。磺胺嘧啶

解析：磺胺嘧啶的特点：血浆蛋白结合率此类中最低，易于透过血脑屏障。尿中析出结晶，应同服等量碳酸氢钠碱化尿液，并多饮水，减轻结晶尿对肾脏的损害（D对）。